5cm×4cm的肾癌，靠近肾门，对侧肾功能正常。应选择的治疗方法是
A. 免疫治疗
B. 随访观察
C. 根治性肾切除术
D. 肾部分切除术
E. 放射治疗

正确答案：C。根治性肾切除术

解析：根治性肾切除术是肾癌最主要的治疗方法。该患者对侧肾功能正常，故应选择的治疗是根治性肾切除术（C对）。免疫治疗（A错）对预防和治疗转移癌有一定的疗效。肾癌为恶性肿瘤，一旦确诊后应尽早手术治疗，不应随访观察（B错），以免错过最佳手术时机。肾部分切除术（D错）主要用于孤立肾肾癌或双侧肾癌。肾癌具有多药物耐药基因，对放射治疗（E错）及化疗不敏感。